急性肾小球肾炎的致病菌是
A. 甲型溶血性链球菌
B. 乙型溶血性链球菌
C. 柯萨奇病体
D. 草绿色链球菌
E. 金黄色葡萄球菌

正确答案：B。乙型溶血性链球菌

解析：草绿色链球菌（D错）属于甲型（α）溶血性链球菌为亚急性心内膜炎的致病菌；乙型（β）溶血性链球菌为急性肾小球肾炎的致病菌（B对）；A组柯萨奇病毒为疱疹性咽峡炎的致病菌，B组柯萨奇病毒为心肌炎的致病菌（C错）；金黄色葡萄球菌（E错）是各类侵袭性疾病（化脓性感染）的致病菌，例如：皮肤化脓性感染、各种器官的化脓性感染（气管炎、肺炎、中耳炎）、全身感染（败血症、脓毒血症）。